4-DAMP（4-二甲基氨基苯酚）是治疗哪种毒物中毒用的药物
A. 硫化氢
B. 氰化氢
C. 一氧化碳
D. 苯胺

正确答案：B。氰化氢

解析：本题考查4-二甲基氨基苯酚的解毒作用。氢氰酸解毒剂的解毒原理是应用适量的高铁血红蛋白生成剂使体内形成一定量的高铁血红蛋白，利用高铁血红蛋白的Fe³⁺与血液中的CN⁻络合成不太稳定的氰化高铁血红蛋白。4-二甲基氨基苯酚（4-DMAP）的应用：为新型高铁血红蛋白生成剂”（B对ACD错），形成高铁血红蛋白的速度比亚硝酸钠快，对平滑肌无扩张作用。